对β-内酰胺酶有抑制作用的药物是
A. 阿莫西林
B. 亚胺培南
C. 氨曲南
D. 克拉维酸
E. 替莫西林

正确答案：D。克拉维酸

解析：本题考查克拉维酸。克拉维酸（D对）为β-内酰胺酶抑制剂，可与β-内酰胺类抗生素联合应用，增强药效。阿莫西林（A错）为广谱青霉素类，主要作用于对青霉素敏感的革兰阳性菌以及部分革兰阴性杆菌。亚胺培南（B错）为碳青霉烯类药，对革兰阳性菌、革兰阴性菌、需氧菌、厌氧菌均有很强的抗菌活性。氨曲南（C错）对需氧革兰阴性菌作用强。替莫西林（E错）为耐β-内酰胺酶的半合成青霉素类抗生素，对G⁻杆菌作用强，对G⁺作用弱。